食品安全国家标准的编号由（）提供
A. 国务院卫生行政部门
B. 国务院食品药品监督管理部门
C. 国务院标准化行政部门
D. 省级卫生行政部门
E. 国家标准审评委员会

正确答案：C。国务院标准化行政部门